下列关于菌血症的叙述正确的是
A. 病原菌侵入血流并在血中大量繁殖
B. 病原菌侵入血流尚未在血中大量繁殖
C. 病原菌在局部生长繁殖产生毒素侵入血流
D. 化脓菌侵入血流并在血中繁殖
E. 只有产生外毒素的细菌侵入血流

正确答案：B。病原菌侵入血流尚未在血中大量繁殖

解析：病原菌经局部组织进入循环血液，尚未大量繁殖和引起严重的临床症状，称作菌血症。掌握“医院感染及细菌的致病性”知识点。